与DNA结合，进而抑制DNA和RNA合成的药物是
A. 紫杉醇
B. 顺铂
C. 氟尿嘧啶
D. 三尖杉酯碱
E. 放线菌素D

正确答案：B。顺铂

解析：本题考查顺铂。与DNA结合，进而抑制DNA和RNA合成的药物是顺铂（B对）。铂类化合物可与DNA结合，破坏其结构与功能，使肿瘤细胞DNA复制停止，阻碍细胞分裂，为细胞增殖周期非特异性抑制剂。紫杉醇（A错）紫杉醇破坏微管和微管蛋白二聚体之间的动态平衡，诱导和促进微管蛋白装配成微管，防止解聚，从而导致微管束的排列异常，使细胞在有丝分裂时不能形成纺锤体和纺锤丝，抑制细胞的有丝分裂，使细胞阻滞于M期，从而发挥抗肿瘤作用。氟尿嘧啶（C错）在体内经活化途径生成5-氟尿嘧啶脱氧核苷酸（5F-dUMP），与胸苷酸合成酶的活性中心共价结合，抑制此酶的活性，使脱氧胸苷酸缺乏，DNA合成障碍。三尖杉酯碱（D错）抑制真核细胞蛋白质合成的起始阶段，使多聚核糖体分解，释放出新生肽链。放线菌素D（E错）能与DNA双螺旋结合产生细胞毒性，嵌入DNA的鸟苷和胞苷的碱基对之间，阻断RNA多聚酶对DNA的转录。